26岁，女性，停经45天，突感下腹坠痛及肛门坠胀感，少量阴道流血及头晕呕吐半天。体格检查：面色苍白，BP80/40mmHg，腹肌略紧张，下腹压痛。妇科检查：阴道少量血性物，宫颈举痛（+），后穹隆饱满，子宫稍大，附件区触诊不满意。本例最可能的诊断是
A. 急性盆腔炎
B. 先兆流产
C. 卵巢囊肿蒂扭转
D. 异位妊娠
E. 难免流产

正确答案：D。异位妊娠

解析：青年女性，停经45天，突感下腹坠痛及肛门坠胀感，少量阴道流血及头晕呕吐半天（异位妊娠的典型症状为停经后腹痛与阴道流血）。体格检查：面色苍白，BP80/40mmHg（当腹腔出血较多时，可出现面色苍白、脉搏快而细弱、心率增快和血压下降等休克表现），腹肌略紧张，下腹压痛（腹部检查：下腹有明显压痛及反跳痛，尤以患侧为著，但腹肌紧张轻微）。妇科检查：阴道少量血性物，宫颈举痛（+），后穹隆饱满（输卵管妊娠流产或破裂者，阴道后穹窿饱满，有触痛。将宫颈轻轻上抬或向左右摆动时引起剧烈疼痛，称为宫颈举痛或摇摆痛），综合以上症状和检查体征，应诊断为异位妊娠（D对）。急性盆腔炎（P261）（A错）常表现为下腹痛，腹痛常为持续性，活动或性交后加重，阴道分泌物增多，病情严重者可出现发热，体格检查可有宫颈举痛或宫体、附件区压痛；卵巢囊肿蒂扭转（P55）腹痛常突发在改变体位后，妇科检查可有宫颈举痛，但二者一般无停经后阴道流血及失血性休克表现。先兆流产（P48）（B错）和难免流产（P48）（E错）均表现为停经后阴道流血和腹痛，但二者腹痛性质为阵发性腹痛伴腰背痛，一般无失血性休克的表现。